一般认为汞中毒机理是其可抑制什么酶的活性
A. 含巯基酶
B. 含氨基酶
C. 含甲基酶
D. 含乙基酶
E. 胆碱酯酶

正确答案：A。含巯基酶

解析：本题考查汞对体内酶的影响。汞进入体内后在血液内通过过氧化氢酶氧化为二价汞离子。汞离子与蛋白质的巯基（A对BCDE错）具有特殊亲和力，而巯基是细胞代谢过程中许多重要酶的活性部分，当汞与这些酶的巯基结合后，可干扰其活性甚至使其失活。